化学毒物引起细胞突变的最直接原因是
A. 细胞膜脂质过氧化损伤
B. 细胞钙稳态失调
C. 蛋白质损伤
D. 核苷酸损伤

正确答案：D。核苷酸损伤

解析：本题考查化学毒物引起细胞突变的最直接原因。化学毒物引起细胞突变的最直接原因是核苷酸损伤（D对ABC错）。